对于青春期牙周炎，首选全身治疗药物
A. 甲硝唑
B. 牙周宁
C. 四环素
D. 青霉素
E. 朵贝尔含漱液

正确答案：C。四环素

解析：本题考查青春期牙周炎的药物治疗。青春期牙周炎，发生在全身健康的年轻人身上，疾病进展快速，有家族聚集性。伴放线聚集杆菌是其主要的致病菌。四环素族药物对于伴放线聚集杆菌具有较强的抑制作用，因此，对于青春期牙周炎，首选全身治疗药物为四环素（C对）。甲硝唑（A错）对于厌氧菌感染所致的坏死性龈炎等疾病具有良好的治疗效果。治疗侵袭性牙周炎时，需与青霉素联合用药，单独使用，效果不佳。牙周宁（B错）的主要成分：固醇可以防氧化及抑制牙周细菌生长，从而起到改善牙齿的病理性松动、抗牙龈出血作用。对于青春期牙周炎治疗效果不如四环素显著。青霉素（D错）治疗侵袭性牙周炎时，需与甲硝唑联合用药，单独使用，效果不佳。朵贝尔含漱液（E错）由硼砂、甘油、碳酸氢钠配制而成,含有苯酚,溶液呈微碱性,有利于除去口腔微酸性分泌物,溶解粘液蛋白。但对于青春期牙周炎无显著治疗效果。